毒物的脂/水分配系数低提示毒物易于
A. 被机体吸收
B. 在体内蓄积
C. 被肾排泄
D. 被机体代谢
E. 与血浆蛋白结合

正确答案：C。被肾排泄